某男，35岁。患风湿热痹，两足浮肿疼痛尿少。宜选用的药是
A. 桑寄生
B. 萆薢
C. 防己
D. 千年健
E. 秦艽

正确答案：C。防己

解析：本题考查的是防己的主治病证。患风湿热痹，两足浮肿疼痛尿少。宜选用的药是防己（C对）。防己：【主治病证】（1）风湿痹痛，尤以热痹为佳。（2）水肿，腹水，脚气浮肿，小便不利。桑寄生（A错）：【主治病证】（1）风湿痹证，腰膝酸痛。（2）肝肾虚损，冲任不固所致的胎漏，胎动不安。萆薢（B错）：【主治病证】（1）膏淋，白浊。（2）湿盛带下。（3）风湿痹痛。千年健（D错）：【主治病证】风寒湿痹，腰膝冷痛，下肢拘挛麻木。秦艽（E错）：【主治病证】（1）风湿热痹，风寒湿痹，表证夹湿。（2）骨蒸潮热。（3）湿热黄疸。